所有伤害都享有一个共同致病机制，即
A. 不安全行为
B. 不安全状态
C. 伤害的能量交换模型
D. 伤害的物质交换模型
E. 管理失误

正确答案：C。伤害的能量交换模型